初产妇，23岁。规律宫缩10小时，连续观察2小时，宫口由6cm开大至7cm，胎头+1，胎心140次/分。恰当的处置应为
A. 严密观察产程进展
B. 肌注杜冷丁
C. 静脉滴注缩宫素
D. 立即行人工破膜
E. 立即行剖宫产术

正确答案：A。严密观察产程进展

解析：青年初产妇，规律宫缩10小时，连续观察2小时，宫口由6cm开大至7cm（活跃期是指宫口扩张3～10cm，活跃期宫口扩张速度为0.5cm/h），按八版教材该孕妇可考虑为活跃期延长，符合人工破膜（D对）的指征（人工破膜适用于宫口扩张≥3cm、无头盆不称、胎头已衔接而产程延缓者）。按九版教材活跃期宫颈口扩张速度＜0.5cm/h 称为活跃期延长，所以该患者属于正常产程，应该严密观察产程进展（A对），原答案为D。由于不能确定是否有剖宫产适应证以及题干没有提及产妇剧烈疼痛，肌注杜冷丁（P190）（B错）主要用于不协调性宫缩乏力。静脉滴注缩宫素（P189）（C错）适用于协调性宫缩乏力或使不协调宫缩乏力恢复协调性。